基因重组不包括
A. 转化
B. 转换
C. 整合
D. 转导
E. 转位

正确答案：B。转换